男，32岁。发热、下腹痛、腹泻1个月。体温最高38.1℃，大便3次/日，黄稀便，无脓血。查体：T37.5℃，P90次/分，R18次/分，BP120/80mmHg。双肺呼吸音清，未闻及干湿啰音，心律齐，腹软，无压痛。腹部B超示右下腹部肠壁增厚。对诊断最有意义的检查是
A. 腹腔镜
B. 下消化道X线钡剂造影
C. 腹部CT
D. 结肠镜
E. 腹部X线平片

正确答案：D。结肠镜

解析：患者青年男性，发热、下腹痛、腹泻1个月。体温最高38.1℃，大便3次/日，黄稀便，无脓血（消化道症状为主）。查体：T37.5℃（低热，正常值36～37℃），P90次/分（正常值60～100次/分），R18次/分（正常值12～20次/分），BP120/80mmHg（正常值收缩压为90～120mmHg，舒张压为60～80mmHg）。双肺呼吸音清，未闻及干湿啰音，心律齐，腹软，无压痛（无腹膜炎表现）。腹部B超示右下腹部肠壁增厚，肠壁增厚常见原因为炎性增厚或肿瘤，对诊断最有意义的检查是结肠镜，不仅能够直接观察病变的部位和范围，并可以对可疑病灶钳取小块组织作病理学检查（D对）。腹腔镜（A错）可用于腹腔探查，帮助诊断，但对患者创伤相对较大，不作首选。下消化道X线钡剂造影（B错）可用于结直肠肿瘤的辅助检查，但仅能显示腔壁异常，不能评价病变的壁外延伸情况，具有局限性，诊断价值不如内镜（P382）。腹部CT（C错）主要用于了解结直肠癌肠外浸润及转移情况，有助于进行临床病理分期，以制订治疗方案，对术后随访亦有价值。但对早期诊断价值有限，且不能对病变活检，对细小或扁平病变存在假阴性、因粪便可出现假阳性（P382）。腹部X线平片（E错）有较大应用限度，除用于肠梗阻、胃肠道穿孔等急腹症的检查，对其余消化系统疾病无太大应用价值。